导致支气管平滑肌舒张的肾上腺素能受体为
A. α受体
B. β受体
C. β₂受体
D. M受体
E. N₁受体

正确答案：C。β₂受体